生物药剂学分类系统根据药物溶解性和肠壁渗透性的不同组合将药物分为四类。卡马西平属于第Ⅱ类，是低水溶性、高渗透性的亲酯性分子药物，其体内吸收取决于
A. 渗透效率
B. 溶解速率
C. 胃排空速度
D. 解离度
E. 酸碱度

正确答案：B。溶解速率

解析：本题考查生物药剂学分类系统。生物药剂学分类系统根据药物溶解性和肠壁渗透性的不同组合将药物分为四类，其中卡马西平是第Ⅱ类，为低水溶性、高渗透性的亲脂性分子药物，其体内吸收取决于溶解速率（B对）。第I类是高水溶解性、高渗透性的两亲性分子药物，其体内吸收取决于胃排空速率（C错），如普萘洛尔、依那普利、地尔硫䓬等；第Ⅲ类是高水溶解性、低渗透性的水溶性分子药物，其体内吸收受渗透效率影响（A错），如雷尼替丁、纳多洛尔、阿替洛尔等；第IV类是低水溶解性、低渗透性的疏水性分子药物，其体内吸收比较困难，如特非那定、酮洛芬、呋塞米等。